奥美拉唑属于
A. H₂受体阻断药
B. M受体阻断药
C. H⁺-K⁺-ATP酶抑制剂
D. H₁受体阻断药
E. 助消化药

正确答案：C。H⁺-K⁺-ATP酶抑制剂